连续供给物料并不断取出细粉的粉碎方法属于
A. 自由粉碎
B. 开路粉碎
C. 循环粉碎
D. 低温粉碎
E. 干法粉碎

正确答案：B。开路粉碎